对病毒和真菌污染的物品消毒，最好采用
A. 过氧乙酸
B. 漂白粉
C. 酒精
D. 来苏儿
E. 紫外光

正确答案：A。过氧乙酸

解析：本题考查对病毒和真菌污染的物品消毒，最好采用的消毒剂。对病毒和真菌污染的物品消毒，最好采用过氧乙酸（A对BCDE错）。过氧乙酸是一种普遍应用的，杀菌能力较强的高效消毒剂，具有强氧化作用，可以迅速杀灭各种微生物，包括病毒、细菌、真菌及芽孢。